关于细菌细胞结构叙述错误的是
A. 细胞壁均有肽聚糖
B. 核糖体沉降系数为70s
C. 核有完整的核膜和核仁
D. L型细菌无细胞壁
E. 中介体多见于G+菌

正确答案：C。核有完整的核膜和核仁

解析：细菌细胞壁主要成分为肽聚糖，功能为保持菌体固有形态和维持菌体内外的渗透压。细菌L型的形态因缺失细胞壁而呈现多形性。其核糖体沉降系数为70s。细菌是原核细胞，不具成形的核，细菌的遗传物质称为核质或拟核，无核膜、核仁和有丝分裂器。中介体亦称为拟线粒体，多见于革兰阳性细菌。掌握“细菌的大小、形态和基本结构”知识点。